内服涌吐痰热，宿食的是
A. 儿茶
B. 轻粉
C. 铅丹
D. 毛茛
E. 瓜蒂

正确答案：E。瓜蒂

解析：本题考查的是瓜蒂的功效。内服涌吐痰热，宿食的是瓜蒂（E对）。瓜蒂：【功效】内服涌吐热痰、宿食；外用研末吹鼻，引去湿热。儿茶（A错）：【功效】收湿敛疮，生肌止血，活血止痛，清肺化痰。轻粉（B错）：【功效】外用杀虫、攻毒、敛疮；内服祛痰消积，逐水通便。铅丹（C错）：【功效】外用拔毒止痒，敛疮生肌；内服坠痰镇惊，攻毒截疟。毛茛（D错）：【功效】发泡止痛，攻毒杀虫。